会加重奥沙利铂所致的严重神经系统毒性（感觉障碍、痉挛）的行为是
A. 饮用热饮
B. 日光浴
C. 接触塑料制品
D. 冷水浴
E. 温泉浴

正确答案：D。冷水浴

解析：本题考查奥沙利铂的使用。会加重奥沙利铂所致的严重神经系统毒性（感觉障碍、痉挛）的行为是冷水浴（D对）。由于遇冷可加重奥沙利铂的神经毒性，甚至可因咽喉痉挛而致严重后果，奥沙利铂静脉滴注期间不可食用冷食和饮用冷水，并避免接触冰冷的物体。